以下有关恶性淋巴瘤的临床特征中，不正确的是
A. 霍奇金淋巴瘤较为多见
B. 以儿童与青壮年多发
C. 我国的恶性淋巴瘤中大多属结外型
D. 发生与免疫功能紊乱、长期抗原刺激等因素有关
E. 以颈部淋巴结最好发

正确答案：A。霍奇金淋巴瘤较为多见

解析：恶性淋巴瘤在病理上可分为霍奇金淋巴瘤与非霍奇金淋巴瘤两大类。其中临床以非霍奇金淋巴瘤多见。掌握“恶性淋巴瘤”知识点。